医疗器械的基本质量特性是
A. 有效性和适用性
B. 经济性和适用性
C. 安全性和可靠性
D. 可靠性和追溯性
E. 安全性和有效性

正确答案：E。安全性和有效性

解析：本题考查的是医疗器械的基本质量特性。医疗器械的基本质量特性是安全性和有效性（E对）。根据产品质量法的解释，产品质量是指产品满足需要的有效性、安全性、适用性、可靠性、维修性、经济性和环境等所具有的特征和特性的总和。不同产品的质量特性，其侧重点也不相同。医疗器械是关系人民生命健康的特殊产品，它的基本质量特性就是安全性和有效性。